患儿，5岁。发热恶寒1天，咳嗽频频，咯白稀痰。查体体温37.5℃，舌苔白，脉浮紧。治疗应首选
A. 金沸草散
B. 华盖散
C. 杏苏散
D. 荆防败毒饮
E. 桑杏汤

正确答案：A。金沸草散

解析：本病例以咳嗽频繁为主症，故诊断为咳嗽；风寒外束，腠理闭塞，故发热恶寒；风寒犯肺，肺气不能宣畅，故咳嗽频频；风寒闭肺，水液输化无权，留滞肺络，凝而为痰，故咯白稀痰；舌苔白，脉浮紧，均主邪在表分，故其证型为风寒咳嗽，治以疏风散寒，宣肺止咳，方药为金沸草散（A对）。华盖散（B错）其功用为宣肺解表，祛痰止咳，适用于素体痰多，肺感风寒证。杏苏散（C错）其功用为清宣凉燥，理肺化痰，适用于外感凉燥证。荆防败毒饮（D错）其功用为发汗解表，消疮止痛，适用于疮肿初起。桑杏汤（E错）其功用为清宣温燥，润肺止咳，适用于外感温燥证。